细胞损伤后释放出的组织凝血活酶的作用是
A. 和凝血因子XI共同激活凝血因子IX
B. 和Ca2+、凝血因子V、Ⅹ共同激活凝血酶
C. 激活凝血因子X
D. 激活凝血因子Ⅻ
E. 和Ca2+、凝血因子VII共同激活凝血因子X

正确答案：E。和Ca2+、凝血因子VII共同激活凝血因子X

解析：细胞损伤后释放出的组织凝血活酶的作用是和Ca2+、凝血因子VII共同激活凝血因子X（E对ABCD错），因为血液中的 FVll含有 Ca2+结合氨基酸，组织因子释放后，形成 TF-Ca2+-VII复合物，FVll被激活为FVlla。TF-Vlla 可激活FX。